属于孕期危险因素的是
A. 年龄19岁
B. BMI20.6kg/m²
C. 身高1.6m
D. 贫血
E. 初次怀孕

正确答案：D。贫血

解析：本题考查妊娠的高危因素。妊娠的高危因素归纳起来有以下几类危险因素：（1）基本情况：年龄、身高、或对生育可能有影响因素等；（2）异常妊娠及分娩史；（3）妇产科疾病及手术史；（4）既往或现患有内外科疾病或妇科疾病：贫血（D对ABCE错）、活动性肺结核、心脏病、糖尿病、血液病、肝炎等；（5）本次妊娠的异常情况：妊娠剧吐、发热、头晕、头痛、出血、腹痛、服药情况等；（6）辅助检查：血红蛋白血小板计数、梅毒筛查阳性等。